乙型肝炎后肝硬化的主要合并症不包括
A. 肝癌
B. 门静脉高压症
C. 急性肠系膜上静脉血栓形成
D. 肝功能衰竭
E. 急性肝静脉血栓形成

正确答案：E。急性肝静脉血栓形成

解析：HBV感染→慢性肝炎→肝硬化→肝癌是病情发展的一般规律，故乙型肝炎后肝硬化可合并肝癌（A对）。乙型肝炎后肝硬化可导致窦后阻塞，引起门静脉高压症（B对）。乙型肝炎后肝硬化可并发门静脉血栓形成，肠系膜上静脉属门静脉（C对）。乙型肝炎后肝硬化可表现为肝功能减退，进行性发展则可并发肝功能衰竭（D对）。肝静脉血栓形成（E错，为本题正确答案）见于布-加综合征。